中央旁小叶位于
A. 中央前回
B. 中央后回
C. 颞叶
D. 顶叶
E. 大脑半球内侧面

正确答案：E。大脑半球内侧面

解析：中央旁小叶位于大脑半球内侧面（E对）。